较少出现精神病性症状的疾病状态是
A. 强迫状态
B. 谵妄状态
C. 妄想状态
D. 幻觉状态
E. 兴奋状态

正确答案：A。强迫状态

解析：强迫状态（A对）较少出现精神病性症状的疾病状态。兴奋状态（E错）会出现思维行为异常等表现。谵妄状态（B错）主要表现为广泛的认知障碍和相应的精神及行为症状。妄想状态（C错）主要表现为与妄想主题相一致的各种形式的感知觉障碍（如幻觉、错觉和身份认同障碍）以及情绪、态度和行为反应。幻觉状态（D错）主要表现为幻听、幻嗅、幻视、内脏性幻觉等表现。